可抑制CYP3A4，影响西地那非代谢的药品是
A. 硝酸甘油
B. 甲睾酮
C. 非那雄胺
D. 丙酸睾酮
E. 克拉霉素

正确答案：E。克拉霉素

解析：本题考查克拉霉素。可抑制CYP3A4，影响西地那非代谢的药品是克拉霉素（E对）。克拉霉素可以抑制肝药酶CYP3A4，能够减慢西地那非的肝脏代谢。